单、双侧游离缺失采用混合支持式义齿设计时，应取
A. 解剖式印模
B. 无压力印模
C. 功能性印模
D. 二次印模
E. 一次印模

正确答案：C。功能性印模

解析：本题考查可摘局部义齿印模的种类。单、双侧游离缺失采用混合支持式义齿设计时，应取功能性印模（C对）。1.选择性压力印模：指远中游离端缺牙区域承受一定压力，而余留天然牙在轻压或无压力状态下取得的印模。适用于基牙和黏膜混合支持式义齿，特别是牙列缺失类型为Kennedy第一类和第二类的义齿修复，这种义齿在功能状态时，鞍基远端下沉的程度较基牙端多，这种不同程度的鞍基下沉也使基牙受到向远中牵拉的扭力。因此，对于缺牙区牙槽嵴有明显吸收，黏膜和黏膜下组织松软且动度较大的游离端缺失的病例，最好能采用选择性压力印模的技术，以弥补鞍基远端下沉过多的问题。2.解剖式印模（A错）：此种印模是在承托义齿的软硬组织处于非功能状态下取得的印模，为无压力印模（B错），通常用流动性较好的印模材料制取。它可以准确地印记牙和牙槽嵴的解剖形态，据此所做的义齿对牙和所接触的其他组织皆不产生压力，对牙支持式和黏膜支持式义齿都可以采取这种印模。牙支持式义齿的（牙合）力主要由基牙承担，基托可减小，故印模边缘可以短些。黏膜支持式义齿的（牙合）力主要由黏膜和牙槽骨承担，故基托伸展较多，但以不妨碍附近组织正常的生理活动为原则。